性平，能祛风通络的中药有
A. 桑枝
B. 丝瓜络
C. 乌梢蛇
D. 海风藤
E. 蕲蛇

正确答案：A、B、C。桑枝；丝瓜络；乌梢蛇

解析：本题考查的是桑枝、丝瓜络、乌梢蛇的性味归经及功效。性平，能祛风通络的中药有桑枝（A对）、丝瓜络（B对）、乌梢蛇（C对）。桑枝【性味归经】苦，平。归肝经。【功效】祛风通络，利水。丝瓜络【性味归经】甘，平。归肺、胃、肝经。【功效】祛风通络，化痰解毒。乌梢蛇【性味归经】甘，平。归肝经。【功效】祛风通络，定惊止痉。桑枝、丝瓜络，均性平而能祛风通络，治风湿痹痛无论寒热新久咸宜。海风藤（D错）【性味归经】辛、苦，微温。归肝经。【功效】祛风湿，通经络。蕲蛇（E错）【性味归经】甘、咸，温。有毒。归肝经。【功效】祛风通络，定惊止痉。